急性胃炎的临床表现不包括
A. 黄疸
B. 消化道出血
C. 呕吐
D. 上腹痛
E. 恶心

正确答案：A。黄疸

解析：急性胃炎常见的临床表现有上腹痛（D对）、胀满、恶心（E对）、呕吐（C对）和食欲不振等；重症可有呕血、黑粪（B对）、脱水、酸中毒或休克。黄疸（A错，为本题正确答案）的常见病因有血管外溶血、肝硬化、病毒性肝炎、胆总管结石等，不是急性胃炎的临床表现。